劳神过度易损伤的脏腑是
A. 心肝
B. 肝肾
C. 脾肾
D. 心脾
E. 脾肺

正确答案：D。心脾

解析：心藏神，脾主思，血是神志活动的重要物质基础，故用神过度，长思久虑，则易耗伤心血，损伤脾气，以致心神失养，神志不宁而心悸、健忘、失眠、多梦和脾失健运而纳少、腹胀、便溏、消痩等，故劳神过度易损伤的脏腑是心脾（D对ABCE错）。